阿托品可
A. 引起骨骼肌松弛
B. 引起内脏平滑肌松弛
C. 治疗青光眼
D. 治疗室上性心动过速
E. 抑制汗腺分泌

正确答案：B、E。引起内脏平滑肌松弛；抑制汗腺分泌

解析：本题考查阿托品。阿托品为M胆碱受体阻断剂，能够抑制腺体分泌，使汗液减少（E对）；阿托品能够松弛胃肠道平滑肌（B对），不能控制骨骼肌（A错）；阿托品使瞳孔扩大、升高眼压，禁用于青光眼（C错）；中高剂量阿托品即可导致心动过速，不能用于治疗室上性心动过速（D错）。